下列不属于缩血管体液因子的是：
A. 血管紧张素Ⅱ
B. 一氧化氮
C. 抗利尿激素(ADH)
D. 血栓素A2
E. 内皮素

正确答案：B。一氧化氮

解析：缩血管体液因子有①血管紧张素II（A对）②血管升压素又称抗利尿激素(ADH)（C对）③血栓素A 2（D对）④内皮素（E对）⑤白三烯类(LTs)物质。一氧化氮（B错，为本题正确答案）不属于缩血管体液因子。